病理情况下，双侧瞳孔缩小见于
A. 阿托品中毒
B. 有机磷农药中毒
C. 视神经萎缩
D. 脑肿瘤
E. 青光眼

正确答案：B。有机磷农药中毒

解析：正常瞳孔直径为2～5mm，双侧等大等圆。病理情况下，双侧瞳孔缩小见于有机磷农药中毒（B对）。阿托品中毒（A错）、视神经萎缩（C错）、青光眼（E错）绝对期表现为瞳孔扩大。脑肿瘤（D错）表现为双侧瞳孔大小不等。